体育运动消耗大量ATP时
A. ADP减少，ATP/ADP比值增大，呼吸加快
B. ADP磷酸化，维持ATP/ADP比值不变
C. ADP增加，ATP/ADP比值下降，呼吸加快
D. ADP减少，ATP/ADP比值恢复
E. 以上都不对

正确答案：C。ADP增加，ATP/ADP比值下降，呼吸加快